关于生殖道感染危害说法错误的是
A. 生殖道感染对女性生殖健康的影响较大
B. 可以造成流产
C. 生殖道感染不会有致命的后果
D. 目前宫颈癌仍是女性生殖器肿瘤死亡的主要原因
E. 人乳头瘤病毒感染大大增加了宫颈癌发生的危险

正确答案：C。生殖道感染不会有致命的后果

解析：本题考查生殖道感染的危害。生殖道感染对女性生殖健康的影响较大（A对），常见的不良结局有盆腔炎、宫颈炎、女性不孕、异位妊娠以及流产（B对）、死胎等，严重者甚至有致命的后果（C错，为本题正确答案），人乳头瘤病毒感染大大增加了宫颈癌发生的危险（E对），且目前宫颈癌仍是女性生殖器肿瘤死亡的主要原因（D对）。